下列哪项描述最接近原发性疱疹性口炎的临床表现
A. 白色网纹样病变
B. 口腔深大溃疡
C. 红色增殖样变
D. 白色角化
E. 较严重的龈口炎

正确答案：E。较严重的龈口炎

解析：最常见的由Ⅰ型单纯疱疹病毒引起的口腔病损，可能表现为一种较严重的龈口炎——急性疱疹性龈口炎。掌握“口腔单纯疱疹”知识点。